患者，男性，35岁，1小时前从二楼跌下，颏部着地，不省人事数分钟后清醒。检查：神志清楚，呼吸急促，口唇发绀，鼻翼煽动，下唇及下颌2—2间牙龈撕裂，下颌弓变窄，舌体后坠，口底血肿形成。颌骨骨折发生的部位可能是
A. 正中颏部单线骨折
B. 一侧颏孔区骨折
C. LefortⅢ型骨折
D. 下颌颏部粉碎性骨折
E. 双侧髁状突部骨折

正确答案：D。下颌颏部粉碎性骨折

解析：颏部先着地，下唇及下颌2-2间牙龈撕裂，下颌弓变窄，舌体后坠为颏部粉碎性骨折。掌握“牙槽突骨折、颌骨骨折”知识点。